可用于预防乙肝的人工被动免疫制剂是
A. 乙肝疫苗
B. 胎盘球蛋白
C. 丙种球蛋白
D. 特异性高价免疫球蛋白
E. 人血清白蛋白

正确答案：D。特异性高价免疫球蛋白